《中国药典》规定，防己药材的原植物是
A. 广防己
B. 木防己
C. 粉防己
D. 川防己
E. 湘防己

正确答案：C。粉防己

解析：本题考查的是药材防己的来源。《中国药典》规定，防己药材的原植物是粉防己（C对）。防己：【来源】为防己科植物粉防己的干燥根。中药的同名异物、同物异名现象普遍存在，严重影响中药材的质量。如防己类的商品药材多达10余种，有粉防己、木防己（B错）、广防己（A错）、川防己（D错）等，分属防己科和马兜铃科，其中粉防己含有肌肉松弛成分，有祛风止痛的功效；而广防己含马兜铃酸，具有肾脏毒性，如果误用就有可能导致中毒，现已取消广防己的药用标准。